霍乱的高发季节是
A. 1～3月
B. 4～6月
C. 7～10月
D. 11～12月
E. 全年

正确答案：C。7～10月

解析：霍乱是由霍乱弧菌所致的烈性肠道传染病，在我国流行地区主要为沿海一带，以夏秋季节高发，最早发病在4月份，最迟可到12月份，高峰期为7～10月（C对）。